初产妇，26岁。妊娠39周。分娩过程中自觉下腹部持续疼痛，拒按，烦躁不安。产科检查：下腹部压痛，胎位触不淸，胎心不规律，宫口停止扩张，胎先露部下降停止。诊断为“高张性宫缩乏力”，下列处理错误的是
A. 处理原则是调节子宫收缩，恢复正常节律及其极性
B. 立即静脉注射缩宫素
C. 给予强镇静剂
D. 经上述处理未能得到纠正者，均应行剖宫产术
E. 若不协调宫缩已被控制，但宫缩仍弱，可静脉滴注缩宫素

正确答案：B。立即静脉注射缩宫素

解析：青年初产妇，妊娠39周，分娩时出现高张性宫缩乏力（高张性宫缩乏力是由于子宫收缩失去极性和对称性，子宫的收缩完全不协调，属于不协调性宫缩乏力）。高张性宫缩乏力的处理原则是调节子宫收缩，恢复正常节律性和极性（A对）；给予强镇静剂（C对）使产妇充分休息；在宫缩恢复协调性之前，严禁应用缩宫素（B错，为本题正确答案）。若经上述处理，不协调性宫缩未能得到纠正，应行剖宫产术（D对）。若不协调性宫缩已被控制，但宫缩仍较弱时，按协调性宫缩乏力处理，可静脉滴注缩宫素（E对）。